提示结核性脑膜炎进入晚期的临床表现是
A. 昏迷、频繁惊厥
B. 脑膜刺激征
C. 颅神经障碍
D. 性格改变
E. 肢体瘫痪或偏瘫

正确答案：A。昏迷、频繁惊厥

解析：典型结核性脑膜炎起病多较缓慢，病程大致可分为三期：早期（前驱期）可有发热、头痛、盗汗、性格改变（D错）如精神萎靡、食欲不振等表现；中期（脑膜刺激期）可因颅内压增高出现剧烈头痛、喷射状呕吐、嗜睡或烦躁不安等表现，脑膜刺激征（B错）明显，此期可出现颅神经障碍（C错），最常见者为面神经瘫痪，其次为动眼神经和展神经瘫痪；晚期（昏迷期）症状加重，颅内压明显增高，出现昏迷，阵挛性或强直性惊厥频繁发作（A对）。不典型结核性脑膜炎早期可出现脑血管损害，表现为肢体瘫痪或偏瘫（E错）。